依赖整合酶、在两个DNA序列的特异位点间发生的整合称为位点特异
A. 转导
B. 转座
C. 接合
D. 转化
E. 重组

正确答案：E。重组

解析：依赖整合酶、在两个DNA序列的特异位点间发生的整合称位点特异的重组。掌握“DNA重组与基因工程”知识点。